根据《中华人民共和国药品管理法》医疗机构的负责人、药品采购人员、医师等有关人员收受药品生产企业或其代理人给予的财物或其他利益的，由
A. 卫生行政部门处罚
B. 工商行政管理部门处罚
C. 经济综合主管部门处罚
D. 药品监督管理部门处罚
E. 纪检督察部门处罚

正确答案：A。卫生行政部门处罚

解析：本题考查违反药品监督管理规定的法律责任。医疗机构的负责人、药品采购人员、医师等有关人员收受药品生产企业或其代理人给予的财物或其他利益的，由卫生行政部门处罚（A对）。《药品管理法》第一百四十二条第2款规定了对医疗机构的负责人、药品采购人员、医师、药师等人员的处罚。该条款规定：医疗机构的负责人、药品采购人员、医师、药师等有关人员收受药品上市许可持有人、药品生产企业、药品经营企业或者代理人给予的财物或者其他不正当利益的，由卫生健康主管部门或者本单位给予处分，没收违法所得；情节严重的，还应当吊销其执业证书。药品生产企业或其代理人给予使用其药品的医疗机构的负责人、药品采购人员、医师等有关人员以财物或其他利益的，由市场监督管理部门（B错）处罚。经济综合主管部门（C错）负责经济运行监测与预测、固定资产投资管理等。药品监督管理部门（D错）负责起草食品安全、药品、医疗器械、化妆品监督管理的法律法规草案，制定食品行政许可的实施办法并监督实施等。纪检督察部门（E错）负责调查处理药品监督管理人员违反行政纪律的行为等。